小柴胡汤中和解少阳的药物配伍是
A. 柴胡、半夏
B. 柴胡、人参
C. 柴胡、黄芩
D. 半夏、生姜
E. 人参、大枣

正确答案：C。柴胡、黄芩

解析：小柴胡汤中和解少阳的药物配伍是柴胡、黄芩。柴胡透泄少阳之邪，并能疏泄气机之郁滞，使少阳半表半里之邪得以疏散。黄芩清泄少阳半里之热（C对）。半夏降逆止呕（A错）。人参益气（B错）。半夏、生姜和胃降逆止呕（D错）。人参、大枣益气健脾，扶正祛邪，御邪内传（E错）。